下列属于繁殖期杀菌的药物有
A. 氯霉素
B. 头孢菌素
C. 氨曲南
D. 四环素
E. 磺胺嘧啶

正确答案：B、C。头孢菌素；氨曲南

解析：本题考查繁殖期杀菌药。头孢菌素（B对）、氨曲南（C对）为繁殖期杀菌药。四环素（D错）为快速抑菌剂。磺胺嘧啶（E错）与对氨基苯甲酸（PABA）竞争二氢叶酸合成酶，阻止细菌二氢叶酸的合成，使RNA和DNA合成受阻，最终抑制细菌生长繁殖。氯霉素（A错）能抑制蛋白质合成，从而致细菌死亡。